关于急性肾炎的治疗，错误的是
A. 一般有自愈倾向可不治疗
B. 需应用抗生素控制感染
C. 应常规应用糖皮质激素治疗
D. 有时需急诊透析治疗
E. 应低盐饮食

正确答案：C。应常规应用糖皮质激素治疗

解析：急性肾炎一般有自愈倾向可不治疗（A对），不宜使用糖皮质激素治疗（C错，为本题正确答案），因糖皮质激素可降低患者的免疫力，不利于患者的恢复。具体治疗原则包括：①一般治疗：急性期应卧床休息、低盐饮食（E对）；对肾功能不全的患者还应限制蛋白质摄入，并以优质动物蛋白为主；明显少尿者应注意控制液体入量；②本病主要为链球菌感染后的免疫反应所致，以往认为需应用抗生素控制感染（B对）；③对症治疗：包括利尿消肿、降血压、预防心脑并发症的发生；④透析治疗：少数发生急性肾衰竭而有透析指征时（如血钾＞6.5mmol/L，血肌酐＞707.2umol/L等），需急诊透析治疗（D对）。